有功能的垂体腺瘤最常见的是
A. ACTH瘤
B. TSH瘤
C. GH瘤
D. PRL瘤
E. FSH/LH瘤

正确答案：D。PRL瘤

解析：功能性垂体腺瘤是指腺瘤激素分泌过多致血中激素水平升高，有激素分泌过多的临床表现。功能性垂体腺瘤以PRL瘤（D对）（催乳素瘤）最常见，约占15%～20%，其他依次为GH瘤（C错）（生长激素瘤）、GH-PRL瘤、ACTH瘤（促肾上腺皮质激素瘤）（A错）、促性腺激素瘤、多激素腺瘤和TSH瘤（B错）等。